菌斑形成过程中，最早吸附到获得性膜上的细菌是
A. 血链球菌
B. 乳杆菌
C. 韦永菌
D. 梭状杆菌
E. 变形链球菌

正确答案：A。血链球菌

解析：血链球菌：是最早在牙面定居的细菌之一。该菌与变形链球菌一样，能利用蔗糖合成水溶性与水不溶性细胞外多糖。这些细菌对牙菌斑形成和细菌在硬组织上聚集有重要作用。目前已证实血链球菌在动物模型中具有致龋性，尚无充分证据表明血链球菌是人类龋病的致龋细菌。掌握“龋病概述”知识点。